牙龈炎区别于早期牙周炎的重要指标是
A. 袋深度大于3mm
B. 牙龈肿胀增生
C. 牙龈易出血
D. 是否有附着丧失
E. 牙槽骨嵴顶无吸收

正确答案：D。是否有附着丧失

解析：健康的龈沟探诊深度一般不超过2～3mm，当牙龈有炎症时，由于组织的水肿或增生，龈沟的探诊深度可达3mm以上，但上皮附着（龈沟底）的位置仍在釉牙骨质界处，临床上不能探到釉牙骨质界，也就是说此时尚无附着丧失，也无牙槽骨吸收，形成的是假性牙周袋。是否有附着丧失是区别牙龈炎和牙周炎的关键指征。掌握“慢性龈炎”知识点。